正确描述巩膜的是
A. 构成眼球中膜
B. 呈棕黑色
C. 透明
D. 占纤维膜的后5／6
E. 前方与晶状体相连

正确答案：D。占纤维膜的后5／6

解析：巩膜占眼球纤维膜的后5/6（D对），乳白色，而非棕黑色（B错），不透明，而非透明（C错），构成眼球的前膜，而非眼球中膜（A错）。前方与晶状体相连的是玻璃体（E错），而非巩膜。